女性腹膜腔的最低处
A. 直肠子宫陷凹
B. 膀胱子宫陷凹
C. 坐骨肛门窝
D. 膀胱上窝
E. 膀胱直肠陷凹

正确答案：A。直肠子宫陷凹

解析：女性腹膜腔的最低处为直肠子宫陷凹(A对)。